由抗基底膜Ⅳ型胶原自身抗体引起
A. 自身免疫性血小板减少性紫癜
B. 自身免疫性中性粒细胞减少症
C. 重症肌无力
D. 肺出血肾炎综合征
E. 恶性贫血

正确答案：D。肺出血肾炎综合征

解析：肺出血肾炎综合征由抗基底膜Ⅳ型胶原自身抗体引起。Ⅳ型胶原广泛分布在。肾脏、肺和内耳的基底膜。吸烟可破坏肺泡毛细血管的内皮细胞屏障，使抗基底膜Ⅳ型胶原抗体得以结合于肺基底膜引起损伤性炎症，进而引起肺出血。掌握“常见口腔自身免疫性疾病及自身免疫性疾病的治疗”知识点。